职业病一旦被确诊应首先做何项工作
A. 加强对所在单位的卫生监督
B. 职业性有害因素
C. 有害的生产过程
D. 有害的劳动过程
E. 立即向当地职防机构报告

正确答案：E。立即向当地职防机构报告

解析：本题考查职业病的应对政策。为了及时掌握职业病的发病情况，以便采取预防措施，我国的《职业病防治法》要求，用人单位和医疗卫生机构发现职业病病人或者疑似职业病病人时，应当及时向所在地卫生行政部门和安全生产监督管理部门报告。确诊为职业病的，用人单位还应当向所在地劳动保障行政部门报告（E对ABCD错）。